氯霉素引起的不良反应是
A. 伪膜性肠炎
B. 耳毒性
C. 牙釉质发育障碍
D. 肌腱炎
E. 再生障碍性贫血

正确答案：E。再生障碍性贫血

解析：本题考查氯霉素的不良反应。氯霉素最严重的不良反应为对骨髓的毒性反应，表现为再生障碍性贫血（E对）。